在病例对照研究中，对暴露与疾病进行测量时，可能发生
A. 失访偏倚
B. 信息偏倚
C. 混杂偏倚
D. 时间领先偏倚
E. 时间效应偏倚

正确答案：B。信息偏倚